上颌义齿后堤区位于
A. 磨牙后垫
B. 腭小凹前方
C. 前颤动线之前
D. 前后颤动线之间
E. 后颤动线之后

正确答案：D。前后颤动线之间

解析：本题考查上颌义齿后堤区的位置。上颌后堤区位于前后颤动线之间（D对CE错）。磨牙后垫（A错）是下颌义齿后缘伸展范围的标志，与上颌义齿后堤区无关。上颌义齿后堤区位于腭小凹后方（B错）。